说明某现象发生强度的指标为
A. 构成比
B. 相对比
C. 定基比
D. 环比
E. 率

正确答案：E。率